海洋的富营养化现象主要表现为
A. 赤潮
B. 水华
C. 生物富集
D. 生物多样性减少
E. 水生生物大量繁殖

正确答案：A。赤潮

解析：本题考查海洋富营养化现象的主要表现。海洋富营养化指的是海洋水体中氮、磷等营养盐含量过多而引起的水质污染现象。其主要表现为赤潮（A对BCDE错），是指在特定的环境条件下，海水中某些浮游植物、原生动物或细菌爆发性增殖或高度聚集而引起水体变色的一种有害生态现象。